急性下壁ST段抬高型心肌梗死患者ST段抬高的导联为
A. Ⅰ、aVL
B. V7～V9
C. V3R～V5R
D. V1～V3
E. Ⅱ、Ⅲ、aVF

正确答案：E。Ⅱ、Ⅲ、aVF

解析：急性下壁ST段抬高型心肌梗死患者ST段抬高的导联为Ⅱ、Ⅲ、aVF（E对）。